腹痛伴黄疸的是
A. 中毒性心肌炎
B. 胰头癌
C. 化脓性胆管炎
D. 慢性肠炎
E. 绞窄性肠梗阻

正确答案：B。胰头癌

解析：腹痛伴黄疸的是胰头癌（B对）。中毒性心肌炎可表现为胸闷肝，心悸，发热，腹泻，消化不良等（A错）。腹痛伴高热寒战的是化脓性胆管炎（C错）。腹痛伴腹泻见于慢性肠炎（D错）。腹痛伴休克或便血是绞窄性肠梗阻（E错）。